经期可出现
A. 下腹和腰骶部不适
B. 子宫收缩痛
C. 胃肠道紊乱症状
D. 神经系统不稳定症状
E. 以上全可以出现

正确答案：E。以上全可以出现

解析：本题考查经期可出现的症状。经期因内分泌改变、盆腔充血以及前列腺素的作用，在经前数天或经期可出现下腹部及腰骶部下坠不适或子宫收缩痛、头痛、疲乏、嗜睡、水肿、乳房胀、情绪波动和低落、易怒，以及腹泻等胃肠功能紊乱症状（E对ABCD错），均为正常现象，不必过分紧张。应保持心情舒畅，自我调节情绪，就可以减轻经期不适感，也能防止月经失调。